男，60岁。右季肋部胀痛，食欲减退，尿黄6个月。乙肝肝硬化病史8年。查体：肝肋下5厘米，表面不平，质硬，压痛。最可能的诊断是
A. 肝脓肿
B. 原发性肝癌
C. 继发性肝癌
D. 乙肝活动期
E. 肝结核

正确答案：B。原发性肝癌

解析：老年患者，乙肝肝硬化8年，有肝区疼痛、消化道症状、肝大，根据其病史体征、临床表现，最可能的诊断是原发性肝癌（B对）。肝脓肿（A错）应有发热寒战。继发性肝癌应有肝外原发癌症病灶（C错）。乙型肝炎活动期不出现肝大（D错）。肝结核（E错）应有结核病史。